女，75岁。胸痛5小时。心电图示V₁-V₅导联ST段抬高0.5mV。【假设信息】住院第7天，患者突然感呼吸困难，不能平卧。查体：双肺闻及细湿啰音，胸骨左缘第4肋间闻及收缩期吹风样杂音。对明确诊断最有意义的辅助检查是
A. 胸部X线片
B. 血B型钠尿肽水平
C. 血气分析
D. 心电图
E. 超声心动图

正确答案：E。超声心动图

解析：患者老年女性，胸痛5小时（心肌缺血、心肌梗死典型症状），心电图示V₁-V₅导联ST段抬高0.5mV（心梗典型心电图）。根据患者症状及心电图，考虑可能是急性心肌梗死。住院第7天，患者突然感呼吸困难，不能平卧（端坐呼吸）。查体：双肺闻及细湿啰音，胸骨左缘第4肋间闻及收缩期吹风样杂音（考虑室间隔穿孔）。综合患者症状及体征，考虑出现室间隔穿孔，可以依靠超声心电图（E对）可以明确心脏具体的定量变化以明确诊断。胸部X线片（A错）主要观察肺部病变及心脏扩张及外形变化。血B型钠尿肽水平（B错）主要用于诊断心力衰竭、监测病程进展、对疗效和预后进行评估，同时用于AMI患者在治疗后对其心室功能的恢复状况进行评估。血气分析（C错）主要用于判断呼吸功能及酸碱平衡状态。心电图（D错）只能了解患者病情，不能明确严重程度亦不能判断器质性变化。